与服务对象的非语言交流的形式不包括
A. 与服务对象面对面相坐，保持合适距离，身体微向前倾
B. 行为端庄大方，礼貌待人，态度认真，平易近人
C. 面带微笑，目光注视服务对象
D. 常常用点头的方式表示对服务对象的赞同
E. 使用与服务对象共同接受的语言

正确答案：E。使用与服务对象共同接受的语言

解析：本题考查非语言交流的形式。使用与服务对象共同接受的语言（E错，为本题正确答案）不属于与服务对象的非语言交流的形式。非语言交流也称为身体语言，包括面部表情、身体姿势、手势和动作，可以起到强化语言交流的作用。应面带笑容，目光注视服务对象（C对），与服务对象面对面相坐，保持合适距离，身体微向前倾（A对），交谈间行为端庄大方，礼貌待人，态度认真，平易近人（B对），适当辅助肢体动作如点头等表示对服务对象的赞同（D对）。